下列关于口底癌治疗的相关叙述中，正确的是
A. 早期浅表的口底鳞癌可用放射治疗
B. 对双侧颈淋巴结转移的患者，可同时或分期行颈淋巴清扫术
C. 早期鳞癌常为溃疡型，以后向深层组织浸润
D. 晚期患者可用化学药物行姑息性治疗
E. 以上均正确

正确答案：E。以上均正确

解析：早期浅表的口底鳞癌可用放射治疗。较晚期的病例，如肿瘤侵及下颌骨，或有颈部淋巴转移时，应施行口底部、下颌骨、颈淋巴联合根治术。对双侧颈淋巴结转移的患者，可同时或分期行颈淋巴清扫术。晚期患者可用放射治疗或化学药物行姑息性治疗。掌握“颊癌、口底癌及唇癌”知识点。